女婴，10个月。面色苍白3个月，嗜睡1周。平时食欲差。生后羊乳喂养，6个月加蜜糖。查体：头发稀黄，面色苍白，巩膜轻度黄染，心尖部可闻及2/6级收缩期杂音，肝下2cm，脾肋下未触及。最可能的诊断是
A. 地中海贫血
B. 营养性巨幼细胞性贫血症
C. 遗传性球形红细胞增多症
D. 缺铁性贫血
E. 再生障碍性贫血

正确答案：B。营养性巨幼细胞性贫血症

解析：患儿的哺乳方式为生后羊乳喂养，6个月加蜜糖（未添加辅食），症状和体征表现为面色苍白（贫血表现）、嗜睡（缺乏维生素B₁₂的神经症状）、厌食，头发稀黄、巩膜轻度黄染、肝肿大（巨幼红细胞胞体大，核幼稚，寿命较短，易被破坏出现黄疸和肝脾肿大），根据临床表现，可能诊断为营养性巨幼细胞性贫血症（B对）。地中海贫血（A错）是溶血性贫血的一种，珠蛋白生成障碍，是遗传性溶血性贫血的一组疾病，易出现贫血、黄疸、脾大等慢性溶血性表现，病人一般有阳性家族史。遗传性球形红细胞增多症（C错）是红细胞膜先天性缺陷的溶血性贫血，以不同程度的贫血、反复出现黄疸、脾肿大为特征。缺铁性贫血（IDA）（D错）是体内铁缺乏导致血红蛋白减少，临床上以小细胞低色素性贫血、血清铁蛋白减少和铁剂治疗有效为特点的贫血症，实验室检查呈小细胞低色素性MCV＜80fl，MCH＜26pg，网织红细胞正常或轻度减少，白细胞、血小板一般无改变，虽也会出现面色苍白和消化系统症状，但不会出现不规则性震颤等神经精神症状。再生障碍性贫血（AA）（E错）是一种由不同病因和机制引起的骨髓造血功能衰竭症，主要表现为骨髓造血功能低下，全血细胞减少和贫血、出血、感染综合征。